软紫草的主产地是
A. 四川
B. 浙江
C. 安徽
D. 新疆
E. 河北

正确答案：D。新疆

解析：本题考查的是紫草的来源与产地。软紫草的主产地是新疆（D对）。紫草：【来源】为紫草科植物新疆紫草或内蒙紫草的干燥根。药材分别习称“软紫草”“内蒙紫草”。【产地】新疆紫草主产于新疆；内蒙紫草主产于内蒙古、甘肃等省区。主产四川（A错）的药材为川药。川药：主产地四川、西藏等。如川贝母、川芎、黄连、川乌、附子、麦冬、丹参、干姜、白芷、天麻、川牛膝、川楝子、川楝皮、川续断、花椒、黄柏、厚朴、金钱草、五倍子、冬虫夏草、麝香等。主产浙江（B错）的药材为浙药。浙药：主产地浙江。如传统的“浙八味”——浙贝母、白术、延胡索、温郁金、玄参、杭白芍、杭菊花、杭麦冬；以及山茱萸、莪术、杭白芷、栀子、乌梅、乌梢蛇等。主产安徽（C错）的药材有：南沙参、百部、菊花、木瓜、决明子、大蓟等。主产河北（E错）的药材有：板蓝根、北柴胡、黄芩、黄精、槲寄生、大青叶、蓼大青叶、酸枣仁等。